下列类型阻生齿是根据阻生齿长轴与第二磨牙的关系而分类的，但不包括
A. 垂直阻生
B. 倒置阻生
C. 中位阻生
D. 近中阻生
E. 舌向阻生

正确答案：C。中位阻生

解析：本题考查阻生牙的分类。下列类型阻生齿是根据阻生齿长轴与第二磨牙的关系而分类的，但不包括在中位阻生（C错，为本题的正确答案）。根据阻生牙相对于第二磨牙（牙合）平面的位置关系分为：高位阻生、中位阻生和低位阻生；根据阻生牙和下颌支前缘相对位置关系分为Ⅰ类、Ⅱ类、Ⅲ类。垂直阻生（A对）、倒置阻生（B对）、近中阻生（D对）、舌向阻生（E对）都是根据阻生齿长轴与第二磨牙长轴的关系而分类的，还包括水平阻生、远中阻生、颊向阻生。